在脑干内与脑神经无关的神经核，是
A. 一般躯体运动核
B. 特殊内脏运动核
C. 一般躯体感觉核
D. 一般内脏感觉核
E. 红核和脑桥核

正确答案：E。红核和脑桥核

解析：脑神经核共分为七种：一般躯体运动核（A对）、特殊内脏运动核（B对）、一般内脏运动核、一般内脏感觉核（D对）、特殊内脏感觉核、一般躯体感觉核（C对）、特殊躯体感觉核。红核和脑桥核（E错，为本题正确选项）为中继核。